令患者闭眼，发现具右眼裂不能完全闭合，考虑可能是
A. 右侧面神经核上瘫
B. 左侧视神经受损
C. 右侧面神经核下瘫
D. 右侧动眼神经受损
E. 无

正确答案：C。右侧面神经核下瘫

解析：侧面神经核的神经元受损，可致病灶侧所有的面肌瘫痪，表现为额横纹消失，眼不能 闭，口角下垂并歪向健侧，鼻唇沟消失，该题患者闭眼，发现具右眼裂不能完全闭合，应考虑右侧面神经核下瘫（C对），右侧面神经核上瘫（A错）表现为左侧鼻唇沟消失，口角低垂并歪向右侧，流涎，不能作鼓腮、露齿等动作，伸舌时舌尖偏向左侧，右侧动眼神经损伤（D错），可致右上脸提肌、上直肌、内直肌、下直肌、下斜肌瘫痪并伴上脸下垂、瞳孔斜向外下方及瞳孔扩大，对光反射消失等症状，左侧视神经受损（B错）信息传入中断，光照左侧眼的瞳孔，两侧瞳孔均 不反应；但光照右侧眼的瞳孔，则两眼对光反射均存在。